有关心壁结构，哪项是错误的
A. 心内膜与大血管内膜相延续
B. 瓣膜是心内膜折叠而成
C. 心房肌与心室肌是相互连续的
D. 心外膜是浆膜性心包的脏层
E. 胎儿时期左、右心房是互通的

正确答案：C。心房肌与心室肌是相互连续的

解析：心内膜与大血管内膜相延续（A对）。心瓣膜是由心内膜向心腔折叠而成（B对）。心房肌和心室肌被心纤维骨骼分开而不延续（C错，为本题正确答案）。心外膜即浆膜性心包的脏层（D对）。